有内在拟交感活性的β受体阻滞剂是
A. 普萘洛尔
B. 美托洛尔
C. 阿替洛尔
D. 比索洛尔
E. 吲哚洛尔

正确答案：E。吲哚洛尔

解析：临床常用的β受体阻断药，其中吲哚洛尔、醋丁洛尔、拉贝洛尔（E对）有内在拟交感活性，可使血管舒张，增加肾血流量。而普萘洛尔（P93）、美托洛尔（P94）、阿替洛尔（P94）、比索洛尔无内在拟交感活性（ABCD错）。